属于电离辐射的物理因素是
A. 可见光
B. X射线
C. 激光
D. 射频辐射
E. 紫外线

正确答案：B。X射线

解析：本题考查电离辐射的种类。电离辐射是指凡能使受作用物质发生电离现象的辐射，可由不带电荷的光子组成，具有波的特性和穿透能力，如X射线（B对）、γ射线。α射线、β射线、中子、质子等属于能引起物质电离的粒子型电离辐射。可见光（A错）、激光（C错）、射频辐射（D错）、紫外线（E错）等均属于非电离辐射。